预防减压病的最好措施是
A. 作业前，可在高原居住一段时问，以适应低压环境
B. 锻炼身体，增强体质
C. 作业时多穿毛衣等柔软衣服
D. 采用阶段减压方法
E. 作业前体检

正确答案：D。采用阶段减压方法